中毒性菌痢最严重的临床表现是
A. 高热
B. 起病急骤
C. 腹痛、腹泻
D. 循环衰竭和呼吸衰竭
E. 脓血便

正确答案：D。循环衰竭和呼吸衰竭

解析：中毒性菌痢临床分为周围循环衰竭型、呼吸衰竭型、混合型，循环衰竭和呼吸衰竭（D对ABCE错）为其最严重的临床表现。由于微循环障碍，可出现面色苍白，皮肤花斑，口唇发绀，四肢厥冷，血压下降甚至测不出，脉搏细数，少尿或无尿，亦可有不同程度的意识障碍；另外循环障碍造成脑缺血等严重者出现呼吸一场甚至衰竭。